5岁小儿，两下肢不包括臀部烧伤，其烧伤面积为
A. 0.34
B. 0.46
C. 0.41
D. 0.39
E. 0.48

正确答案：A。0.34

解析：46-（12-5）=39，由于不包括双臀，再减5%，所以为34%（A对）。